患者，女，8个月。皮肤蜡黄，虚胖，手足颤抖2个月。体检：肝脾轻度增大。血象：红细胞2.1×10¹²/L，血红蛋白80g/L。本病可能的诊断是
A. 营养性巨幼细胞贫血
B. 营养性缺铁性贫血
C. 混合型贫血
D. 蚕豆病
E. 再生障碍性贫血

正确答案：A。营养性巨幼细胞贫血

解析：患儿，女，8个月（营养性巨幼细胞贫血好发年龄为6个月至2岁），皮肤蜡黄（巨幼细胞贫血的皮肤特征），虚胖（巨幼细胞贫血常表现为虚胖，颜面轻度水肿），手足颤抖（巨幼细胞贫血的神经症状，由于缺乏维生素B₁₂所致）。体检：肝脾轻度肿大（髓外造血的表现）。血象：红细胞2.1×10¹²/L（红细胞数下降，巨幼细胞贫血的外周血象特点），血红蛋白80g/L（血红蛋白下降，诊断为中度贫血），综合患儿的病史、症状、体征，考虑为营养性巨幼细胞贫血（A对）。营养性缺铁性贫血（B错）表现为皮肤黏膜苍白，无神经精神症状。混合型贫血（C错）是由于饮食中同时缺乏铁和维生素B₁₂或叶酸等造血物质所致，血象兼有大小细胞性贫血的特点，红细胞大小相差悬殊。蚕豆病（D错）常见于＜10岁的小儿，男孩多见，为食用蚕豆后发生的血管内溶血性贫血。再生障碍性贫血（E错）表现为全血细胞减少，肝脾无肿大。